多见于中年妇女的是
A. 腹股沟斜疝
B. 腹股沟直疝
C. 股疝
D. 脐疝
E. 切口疝

正确答案：C。股疝

解析：腹外疝分为腹股沟疝（又分为腹股沟斜疝和腹股沟直疝），股疝和其他腹外疝（如切口疝、脐疝、白线疝等）。其中多见于中年妇女的是股疝（C对），属最易嵌顿的疝。腹股沟斜疝（A错）多见于儿童及青壮年。腹股沟直疝（B错）多见于老年人。脐疝（D错）是疝囊通过脐环突出的疝，有小儿脐疝和成人脐疝之分，成人脐疝多见于中年经产妇女。切口疝（E错）是发生于腹壁手术切口处的疝，发病年龄无特殊，切口感染可使其发生率增加。